男婴，8个月。腹泻伴呕吐3天，无尿6小时。大便10-15次/天，呈蛋花汤样伴黏液，有腥臭味。查体：T37.8℃，表情淡漠，前囟、眼窝明显凹陷，皮肤弹性差，可见花纹，四肢厥冷，双肺呼吸音清，心率120次/分，腹软，无明显压痛。实验室检查：粪镜检偶见白细胞，血钠134mmol/L。患儿脱水的程度和性质是
A. 重度等渗性脱水
B. 中度等渗性脱水
C. 重度低渗性脱水
D. 中度低渗性脱水
E. 重度高渗性脱水

正确答案：A。重度等渗性脱水

解析：婴幼儿，腹泻伴呕吐3天，无尿6小时（提示重度脱水），大便10-15次/天，呈蛋花汤样伴黏液，有腥臭味，查体：T37.8℃（正常值为36℃～37℃，提示发热），表情淡漠，前囟、眼窝明显凹陷，皮肤弹性差，可见花纹，四肢厥冷（重度脱水的典型临床表现），双肺呼吸音清，心率120次/分（正常值为60～100次/分，心率增快），腹软，无明显压痛，实验室检查：粪镜检偶见白细胞，血钠134mmol/L（正常值为130～150mmol/L，提示等渗脱水），根据患儿的症状、体征及实验室检查，考虑最可能的诊断为腹泻病伴有重度等渗脱水（A对）。